前囟饱满、紧张、隆起，常表示
A. 甲状腺功能减退
B. 佝偻病
C. 脱水
D. 头小畸形
E. 颅内压增高

正确答案：E。颅内压增高

解析：前囟饱满、紧张、隆起，常表示颅内压增高，是婴儿脑膜炎、脑炎或脑积水等重要体征之一；前囟凹陷常见于脱水或极度消瘦患儿。掌握“骨骼发育”知识点。